季铵化合物控制菌斑的主要作用是
A. 干扰菌斑附着
B. 破坏菌斑基质
C. 清除菌斑内毒素
D. 改变细菌细胞膜的渗透性
E. 控制菌斑繁殖

正确答案：D。改变细菌细胞膜的渗透性

解析：本题考查化学制剂控制菌斑-季铵化合物。季铵化合物控制菌斑的主要作用是改变细菌细胞膜的渗透性（D对）。季铵化合物是一组阳离子表面活性剂，能杀灭革兰阳性和革兰阴性细菌，特别对革兰阳性菌有较强的杀灭作用，其机制是与细胞膜作用而改变细菌细胞膜的渗透性，最终使细胞内容物丧失。季铵化合物主要包括氯化苄乙氧铵和氯化十六烷基吡啶，一般以0.05%的浓度作为漱口剂，可抑制菌斑的形成和牙龈炎的发生，长期使用可能出现牙染色、烧灼感或促进牙结石的形成等副作用，该制剂在口腔内很快被清除，故不能保持疗效。干扰菌斑附着（A错）、减少唾液中能吸附到牙面上的细菌是洗必泰控制菌斑的机制之一。菌斑基质是由蛋白质和细胞外多糖构成，洗必泰可与唾液酸性糖蛋白的酸性基团结合，从而封闭唾液糖蛋白的酸性基团，使唾液糖蛋白对牙面的吸附能力减弱，既破坏菌斑基质（B错），又可以抑制获得性膜和菌斑的形成。清除菌斑中的内毒素（C错）是酚类化合物控制菌斑的机制。锡离子进入细菌细胞并滞留，从而影响细胞的生长和代谢、控制菌斑繁殖（E错）、抑制菌斑形成是氟化亚锡控制菌斑的作用机制。